下列不属于社会因素范畴的是
A. 原生环境
B. 次生环境
C. 人口
D. 政治经济
E. 文化

正确答案：C。人口